环孢素所致严重的不良反应是
A. 血尿酸和肌酐升高
B. 呼吸窘迫综合征
C. 肝坏死
D. 深静脉血栓形成
E. 骨质疏松症

正确答案：A。血尿酸和肌酐升高

解析：本题考查环孢素的不良反应。环孢素不良反应有高血压、呕吐、头痛等，但环孢素最严重的不良反应是肾毒性，主要表现为血尿酸和肌酐升高（A对），间质纤维化等。